中年妇女乳头鲜红色血性溢液应首先考虑为
A. 乳管内乳头状瘤
B. 乳腺囊性增生症
C. 乳腺导管扩张症
D. 乳腺纤维腺瘤
E. 乳腺癌

正确答案：A。乳管内乳头状瘤

解析：中年妇女乳头鲜红色血性溢液应首先考虑乳管内乳头状瘤（A对）。本病好发于40~50岁的经产妇，75％的病例瘤体位于大乳管近乳头的壶腹部，瘤体通常很小，带蒂而有绒毛，且有很多薄壁的血管，容易出血，产生血性溢液。乳腺囊性增生症（B错）主要表现为乳房胀痛及肿块，仅少数病人有乳头溢液，多为浆液性或浆液血性液体。乳腺导管扩张症（C错）又称浆细胞性乳腺炎，为乳腺组织的无菌性炎症，局部可出现红、肿、痛等症状，部分病人在疾病早期可有一侧或双侧乳头浆液性排液。乳腺纤维腺瘤（D错）一般仅表现为乳腺单发肿块，无乳头溢液。乳腺癌（E错）多表现为患侧乳房无痛性单发肿块，仅极少数病人出现血性溢液。